下列关于五行生克规律的表述，正确的是
A. 木为土之所胜
B. 木为水之子
C. 火为土之子
D. 水为火之所胜
E. 金为木之所胜

正确答案：B。木为水之子

解析：本题考查五行生克规律，属于理解记忆内容。水生木，木为水之子（B对）。木克土，木为土之所不胜（A错）。火生土，土为火之子（C错）。水克火，水为火之所不胜（D错）。金克木，金为木之所不胜（E错）。